哪项正确
A. 是指所有形状长的骨
B. 骨干内具有含气的腔
C. 骨表面均覆盖有骨膜
D. 骺线是成年后骨化了的骺软骨
E. 上述都不对

正确答案：D。骺线是成年后骨化了的骺软骨

解析：骺线是成年后骨化了的骺软骨（D对）。长骨呈长管状，分为一体两端（A错），体又称骨干, 内有空腔称髓腔（B错）。